患者全身水肿，颈静脉怒张，肝大，应考虑
A. 肾性水肿
B. 心源性水肿
C. 肝源性水肿
D. 内分泌性水肿
E. 营养不良水肿

正确答案：B。心源性水肿